肝硬化导致食管胃底急性出血时不能做的是
A. 非选择性TIPS
B. 急诊手术
C. 胃镜
D. 三腔两囊管压迫止血
E. 垂体后叶素静点

正确答案：B。急诊手术

解析：肝硬化导致食管胃底急性出血时，使用急诊手术并发症多，死亡率高，目前多不采用（B错，为本题正确答案）。非选择性tips（A对）、胃镜（C对）、三腔两囊管压迫（C对）和垂体后叶素静点（E对）都可以用来止血。